可维持循环系统对儿茶酚胺的敏感性
A. 蓝斑-去甲肾上腺素能神经元／交感-肾上腺髓质系统兴奋
B. 下丘脑-垂体-肾上腺皮质系
C. 肾素-血管紧张素-醛固酮系统兴奋
D. 急性期反应蛋白
E. β-内啡肽

正确答案：B。下丘脑-垂体-肾上腺皮质系

解析：下丘脑-垂体-肾上腺皮质系（B对）可维持循环系统对儿茶酚胺的敏感性。